氨基糖苷类抑制细菌蛋白质合成的主要因素是
A. 与细菌体内核糖体70S亚基形成始动复合物
B. 阻滞肽链释放因子进入A位，使合成好的肽链不能释放
C. 选择性地与细菌体内核糖体30S亚基结合
D. 抑制核糖体70S亚基的解离
E. 以上均对

正确答案：E。以上均对

解析：氨基糖苷类的抗菌机制主要是抑制细菌蛋白质合成，还能破坏细菌胞浆膜的完整性。蛋白质合成的影响包括有：①与细菌体内核糖体70S亚基形成始动复合物；②选择性地与细菌体内核糖体30S亚基结合，使mRNA在翻译时出现错误，导致异常或无功能蛋白质合成；③阻滞肽链释放因子进入A位，使合成好的肽链不能释放；④抑制核糖体70S亚基的解离，使菌体内核糖体循环利用受阻。另外，氨基糖苷类还通过吸附作用与菌体胞浆膜结合，使通透性增加，胞质内大量重要物质外漏。掌握“氨基糖苷类抗生素”知识点。